抗菌谱较广但对绿脓杆菌无效的药物是
A. 羟氨苄青霉素
B. 氯霉素
C. 头孢他啶
D. 克拉维酸
E. 红霉素

正确答案：A。羟氨苄青霉素

解析：本题考查羟氨苄青霉素。羟氨苄青霉素（A对）又名阿莫西林，抗菌谱广，主要作用于对青霉素敏感的革兰阳性菌以及部分革兰阴性杆菌，对绿脓杆菌无效。氯霉素（B错）的抗菌机制是抑制细菌蛋白质的合成，导致细菌死亡，用于严重感染、脑膜炎及伤寒的治疗。头孢他啶（C错）对革兰阴性菌包括肠杆菌、铜绿假单胞菌及厌氧菌均有较强的抗菌活性，用于严重感染。克拉维酸（D错）作为β-内酰胺酶抑制剂，可保护不耐酶的抗菌药物结构免受破坏提高抗菌活性和效果。红霉素（E错）为大环内酯类，其通过抑制细菌蛋白质的合成而杀灭细菌，主要用于治疗青霉素过敏患者的替代用药。